药品监督管理部门检查发现，药品上市许可持有人与药品生产企业签订协议，委托其生产并销售药品。药品监督管理部门应当对该行为作出的处理是
A. 超出经营方式经营药品，依据《药品管理法》第一百一十五条对于无证经营情形给予处罚
B. 违反《药品经营质量管理规范》，依据《药品管理法》一百二十六条给予处罚
C. 违反《药品生产质量管理规范》，依据《药品管理法》第一百二十六条给予处罚
D. 违反国家药品管理规定，责令限期整改；逾期不改的，依据《药品管理法》第一百一十五条对于无证经营情形给予处罚

正确答案：D。违反国家药品管理规定，责令限期整改；逾期不改的，依据《药品管理法》第一百一十五条对于无证经营情形给予处罚

解析：本题考查法律责任。第一百一十五条（D对）未取得药品生产许可证、药品经营许可证或者医疗机构制剂许可证生产、销售药品的，责令关闭，没收违法生产、销售的药品和违法所得，并处违法生产、销售的药品（包括已售出和未售出的药品，下同）货值金额十五倍以上三十倍以下的罚款；货值金额不足十万元的，按十万元计算”。